营养性贫血脾胃虚弱证的治疗方剂为
A. 参苓白术散加减或异功散加味
B. 归脾汤加减
C. 左归丸加减
D. 右归丸加减
E. 四物汤加减

正确答案：A。参苓白术散加减或异功散加味

解析：营养性贫血脾胃虚弱证是由于脾胃虚弱，气血生化乏源所致，治疗时应以健运脾胃，益气养血，首选参苓白术散加减或异功散加味（第九版教材为六君子汤）（A对）。归脾汤（B错）其功用为益气补血，健脾养心，适用于营养性缺铁性贫血之心脾两虚证。左归丸（C错）其功用为滋阴补肾，填精益髓，适用于营养性缺铁性贫血之肝肾阴虚证。右归丸（D错）其功用为温补肾阳，填精益髓，适用于营养性缺铁性贫血之脾肾阳虚证。四物汤（E错）其功用为补血调血，适用于营血虚滞证。